下列月经病的治疗，错误的是
A. 重在治本调经
B. 分清先病和后病
C. 急则治标，缓则治本
D. 顺应不同年龄阶段论治
E. 多用辛温暖宫之品

正确答案：E。多用辛温暖宫之品

解析：月经病的治疗原则：重在治本调经，临证中首先分清先病后病（AB错）。月经病的治疗原则：急则治其标，缓则治其本（C错）。月经病还当顺应和掌握规律：1顺应月经周期中阴阳转化和气血盈亏的变化规律2顺应不同年龄阶段的论治规律3掌握虚实补泻的规律（D错）。多用辛温暖宫之品可针对寒凝瘀血型月经病患者，而血热型患者则需慎用禁用辛温之品（E对）。